医学道德评价中自身评价是医务人员
A. 对自己的心理感受所进行的反思
B. 对自己的职业行为所作的评价
C. 对周围同事的错误行为进行的批评
D. 对行业内的不正之风所进行的评价
E. 对所发生的医疗差错事故进行的分析

正确答案：B。对自己的职业行为所作的评价

解析：医学道德评价中自身评价是医务人员对自己的职业行为所作的评价（B对）。